前腭杆的前缘应
A. 位于上前牙舌隆突上
B. 位于上前牙舌侧龈缘
C. 离开上前牙舌侧龈缘3mm
D. 离开上前牙舌侧龈缘6mm
E. 离开上前牙舌侧龈缘10mm

正确答案：D。离开上前牙舌侧龈缘6mm

解析：前腭杆：位于上颌硬区之前，腭皱襞之后，薄而宽，与黏膜组织密合但无压力，应离开龈缘至少6mm。为了不妨碍舌的功能和发音，应该尽量避免覆盖腭前区组织。前部边缘设计于腭皱襞之间。常用铸造法制成，有时也可用成品杆弯制而成。掌握“局部义齿连接体”知识点。